心肌炎发生心力衰竭是由于
A. 容量负荷过重
B. 压力负荷过重
C. 两者均有
D. 两者均无
E. 无

正确答案：D。两者均无

解析：心肌炎时，心肌细胞发生变性、坏死，使心肌收缩性降低而导致心衰。容量负荷过重、压力负荷过重均不属于心肌炎导致心衰的原因（D对）。